患者，女，69岁，因心悸就诊，诊断为心房颤动。既往患慢性肾脏病10年，肌酐清除率25ml/min。宜选用的药物是
A. 达比加群酯胶囊
B. 利伐沙班片
C. 替格瑞洛片
D. 阿司匹林肠溶片
E. 注射用尿激酶

正确答案：B。利伐沙班片

解析：本题考查心房颤动的药物治疗。选择预防房颤患者血栓栓塞事件的经典抗凝药物是维生素K拮抗剂华法林，其在房颤患者卒中一级与二级预防中的作用已得到多项临床研究肯定。而新型口服抗凝药物（NOAC）有用药方法简单、大出血和致命性出血风险较低等特点。普通肝素或低分子肝素为静脉和皮下用药，一般用于华法林开始前或停用华法林期间的短期替代抗凝治疗。阿司匹林或氯吡格雷预防房颤患者并发卒中的有效性远不如华法林，氯吡格雷与阿司匹林合用减少房颤患者并发卒中和非中枢性血栓栓塞的有效性也不如华法林。因此，不推荐抗血小板药物用于房颤患者血栓栓塞的预防。患者肌酐清除率25ml/min，不推荐使用达比加群酯（A错）（肌酐清除率<30ml/min，不推荐使用达比加群酯）；可酌使用利伐沙班（B对）或阿哌沙班。